原发性肝淋巴癌转移，部位最多见的是
A. 腋窝淋巴结
B. 脾脏
C. 肝门淋巴结
D. 锁骨上淋巴结
E. 胰腺

正确答案：C。肝门淋巴结

解析：原发性肝淋巴癌转移，部位最多见的是肝门淋巴结，此时已属于晚期症状，预后差（C对）。